天然水的pH一般为
A. 7
B. 6.5～7.0
C. 7.2～8.5
D. 8.0～9.0
E. 5.0～9.0

正确答案：C。7.2～8.5

解析：本题考查天然水的pH。天然水的pH一般为7.2～8.5（C对ABDE错），这是受到地球表面、地下环境以及水体中的水质成分，如碳酸钙、硫酸钙等的影响。